早期梅毒指的是病程在
A. 1年以内
B. 2年以内
C. 3年以内
D. 4年以内
E. 5年以内

正确答案：B。2年以内